在《中国药典》凡例中，贮藏项下规定的“凉暗处”是指
A. 不超过30℃
B. 不超过20℃
C. 避光并不超过30℃
D. 避光并不超过20℃
E. 2～10℃

正确答案：D。避光并不超过20℃

解析：本题考查中国药典的凡例。在《中国药典》凡例中，贮藏项下规定的“凉暗处”是指避光并不超过20℃（D对）。凉暗处：系指贮藏处避光且温度不超过20°C 。阴凉处：系指贮藏处温度不超过 20°C（B错）。冷处：系指贮藏处温度为 2°C ~ 10°C（E错）。常温：系指温度为 10°C ~ 30°C（AC错） 。